对于痛风急性期患者，饮食干预措施错误的是
A. 选择低嘌呤食物
B. 摄入含果糖较高的食物
C. 禁用油炸、油煎，采用蒸、煮、炖
D. 禁酒及食用刺激性食物
E. 每日食盐量不超过6g

正确答案：B。摄入含果糖较高的食物

解析：本题考查痛风急性期患者的饮食干预措施。对于痛风急性期患者，饮食上应选择低嘌呤食物（A对）；限制含果糖较高食物的摄入（B错，为本题正确答案）；禁用油炸、油煎，采用蒸、煮、炖（C对）；禁酒及食用刺激性食物（D对）；每日食盐量不超过6g（E对）。